在保护病人隐私时应考虑除外
A. 患者不愿让他人知道的变态心理，要求绝对保密
B. 患者不愿让他人知道的个人行为，要求绝对保密
C. 患者不愿让他人知道的家庭生活，要求绝对保密
D. 患者不愿让他人知道的不良诊断，要求绝对保密
E. 患者不愿让他人知道的艾滋病病情，要求绝对保密

正确答案：E。患者不愿让他人知道的艾滋病病情，要求绝对保密

解析：为了诊治的需要，患者有义务将自己与疾病有关的隐私如实地告知医务人员，但是患者也有权维护自己的隐私不受侵害，对于医务人员已经了解的患者隐私，患者享有不被擅自公开的权利。然而，如果患者的“隐私”涉及他人或社会的利益，对他人或社会具有一定的危害性如患甲类传染病，则医务人员有疫情报告的义务，应当如实上报，但应对无关人员保密。掌握“医患关系伦理”知识点。